某糖尿病患者为了控制血糖，在医生的建议下准备和营养师一起定制一份饮食计划。她虽然知道饮食控制的好处，但总认为无法管住自已，计划难以实施。对于这样患者的干预重点是
A. 提高自我效能
B. 培养行为能力
C. 提高结果预期
D. 提供社区支持
E. 建立支持性环境

正确答案：A。提高自我效能

解析：该糖尿病患者虽然知道饮食控制的好处，但总认为无法管住自已，计划难以实施，因此该患者需要有克服障碍的信心，相信自己一定能通过努力完成目标，即提高自我效能（A对）。行为能力是执行特定行为的知识和技能，该患者是缺乏成功控制饮食的信心，而不是缺乏控制饮食的能力，帮重点不是培养行为能力（B错）。结果预期是预期的行为结果，该患者已经知道饮食控制的好处，不需要提高结果预期（C错）。建立健康支持环境（E错）是指在促进入群健康的过程中，必须使物质环境、社会经济环境和社会政治环境都有利于健康，是健康促进的活动领域之一。提供社区支持（D错）是慢性病自我管理的内容之一，主要体现为在社区内持续开展慢性病自我管理健康教育项目，培训患者的自我管理能力。